扩散速度取决于膜两侧药物的浓度梯度、药物的脂水分配系数及药物在膜内扩散速度的药物转动方式是
A. 滤过
B. 简单扩散
C. 易化扩散
D. 主动转运
E. 膜动转运

正确答案：B。简单扩散

解析：本题考查药物的转运方式。简单扩散（B对）是被动转运中的一种，其药物的扩散速度取决于膜两侧药物的浓度梯度、药物的脂水分配系数及药物在膜内的扩散速度；滤过（A错）是水溶性的极性或非极性药物分子借助于流体静压或渗透压随体液通过细胞膜的水性通道而进行的跨膜转运；易化扩散（C错）是需要借助载体的被动运输；主动转运（D错）是借助载体帮助，消耗能量，从膜的低浓度一侧向高浓度一侧转运药物的方式；膜动转运（E错）是指生物膜通过主动变形摄入物质到细胞内或从细胞内释放到细胞外。